有关脊神经丛的描述，正确的是
A. 由脊神经前支交织而成
B. 由脊神经交织而成
C. 由脊神经前支和后支交织而成
D. 有颈丛、胸丛、腰丛、骶丛
E. 有臂丛、腰丛、骶丛、尾丛

正确答案：A。由脊神经前支交织而成

解析：除12对胸神经外，其余脊神经前支形成4个神经丛，即颈丛、臂丛、腰丛和骶丛（A对D错）。